16～17岁女学生从事较重的工农业劳动，其劳动负荷不应超过成人的
A. 0.25
B. 0.4
C. 0.6
D. 50%～60%
E. 70%～75%

正确答案：A。0.25